能够防止氧化热解，提高挥发油品质而且提取效率高的方法是
A. 压榨法
B. 溶剂提取法
C. 水蒸气蒸馏法
D. C02超临界流体提取法
E. 盐析法

正确答案：D。C02超临界流体提取法